原发性肺脓肿最常见的病原菌是
A. 厌氧菌
B. 大肠杆菌
C. 绿脓杆菌
D. 肺炎克雷伯杆菌
E. 金黄色葡萄球菌

正确答案：A。厌氧菌

解析：原发性肺脓肿也称吸入性肺脓肿，是肺脓肿最常见的一种类型。当昏迷、醉酒、药物过量、癫痫、脑血管意外时，或由于受寒、极度疲劳等诱因，全身免疫力与呼吸道防御功能降低，误吸入含病原菌的各种污染物而致病，如口咽分泌物等，其中厌氧菌占90%以上（A对）。大肠杆菌（B错）是肠道的正常菌群，是机会性致病菌，其常导致肠外感染，以泌尿系统感染为主，较少导致呼吸系统感染。肺炎克雷伯杆菌（D错）是医院获得性肺炎常见的致病菌之一，是继发性肺脓肿的常见病原体。金黄色葡萄球菌（E错）多为血源性肺脓肿的感染菌。